桂龙咳喘宁胶囊的功能是
A. 清肺润燥，止咳化痰
B. 降气平喘，止咳化痰
C. 祛风解热，止咳化痰
D. 宣肺化痰，止咳平喘
E. 解表散寒，宣肺止嗽

正确答案：B。降气平喘，止咳化痰

解析：本题考查的是桂龙咳喘宁胶囊的功能。桂龙咳喘宁胶囊的功能是降气平喘，止咳化痰（B对）。桂龙咳喘宁胶囊：【功能】止咳化痰，降气平喘。二母宁嗽丸：【功能】清肺润燥，化痰止咳（A错）。通宣理肺丸：【功能】解表散寒，宣肺止咳（E错）。功能为祛风解热，止咳化痰（C错）或宣肺化痰，止咳平喘（D错）的中成药，2022年考试指南未明确说明。